单位和个人违反《中华人民共和国传染病防治法》，导致传染病传播、流行，给他人人身、财产造成损害的，应依法
A. 恢复原状
B. 进行治疗
C. 承担社会责任
D. 承担道德责任
E. 承担民事责任

正确答案：E。承担民事责任

解析：《中华人民共和国传染病防治法》规定，单位和个人违反本法规定，导致传染病传播、流行，给他人人身、财产造成损害的，应当依法承担民事责任（E对）。